可作为栓剂吸收促进剂的是
A. 聚山梨酯80
B. 糊精
C. 椰油酯
D. 聚乙二醇6000
E. 羟苯乙酯

正确答案：A。聚山梨酯80

解析：本题考查栓剂的附加剂。聚山梨酯80（A对）可作为栓剂的吸收促进剂；糊精（B错）、椰油酯（C错）、聚乙二醇6000（D错）、羟苯乙酯（E错）均不具有吸收促进作用。